正常儿童的听觉强度为
A. 0～20dB
B. 20～40dB
C. 40～60dB
D. 60～80dB
E. 80dB以上

正确答案：A。0～20dB

解析：本题考查听觉发育的相关内容。正常儿童的听觉强度为0～20dB（A对），20～40dB（B错）为轻度听觉障碍，40～60dB（C错）为中度听觉障碍，60～80dB（D错）为重度听觉障碍，80dB以上（E错）为极重度听觉障碍。